坐骨肛门窝的内侧壁为
A. 肛提肌和盆隔上筋膜
B. 肛提肌和盆隔下筋膜
C. Colles筋膜
D. 会阴浅横肌和尿生殖照上筋膜
E. 无

正确答案：B。肛提肌和盆隔下筋膜

解析：肛区的深筋膜覆盖于坐骨肛门窝的各壁，肛提肌和盆膈下筋膜构成了坐骨肛门窝的内侧壁（B对）。